患儿，11个月。早产、生后一直人工喂养。近4个月来食欲不振，面色㿠白，唇舌爪甲苍白，毛发稀黄，精神萎靡，手足欠温，舌淡苔白，指纹淡。检查：血红蛋白60g/L。治疗应首选
A. 金匮肾气丸
B. 六味地黄丸
C. 右归丸
D. 理中丸
E. 小建中汤

正确答案：C。右归丸

解析：题中患儿经常泄泻，近四个月来食欲不振，故营养不良，唇舌爪甲苍白，加之血红蛋白60g／L，故诊断为营养性缺铁性贫血。面色㿠白，精神萎靡，手足欠温，舌淡苔白，指纹淡为血虚日久，阴损及阳所致，故辨为脾肾阳虚证，治宜温补脾肾，益阴养血。金匮肾气丸功能补肾助阳，主治肾阳不足证（A错）。六味地黄丸功能滋补肝肾，主治肝肾阴虚证（B错）。右归丸功能温补脾肾，填精益髓，为营养性缺铁性贫血脾肾阳虚证的选方（C对）。理中丸功能温中祛寒，补气健脾，主治脾胃虚寒证（D错）。小建中汤功能温中补虚，和里缓急，主治中焦虚寒，肝脾不和证（E错）。